断面可见大理石样花纹的饮片有
A. 大黄
B. 鸡血藤
C. 肉豆蔻
D. 大血藤
E. 槟榔

正确答案：C、E。肉豆蔻；槟榔

解析：本题考查的是肉豆蔻、槟榔的性状鉴别。断面可见大理石样花纹的饮片有肉豆蔻（C对）、槟榔（E对）。肉豆蔻：【性状鉴别】药材呈卵圆形或椭圆形。表面灰棕色或灰黄色，有时外被由粉（石灰粉末）。全体有浅色纵行沟纹和不规则网状沟纹。种脐位于宽端，呈浅色圆形突起，合点呈暗凹陷。种脊呈纵沟状，连接两端。质坚，断面显棕黄色相杂的大理石样花纹，宽端可见干燥皱缩的胚，富油性。气香浓烈，味辛。槟榔：【性状鉴别】药材呈扁球形或圆锥形。表面淡黄棕色或淡红棕色，具稍凹下的网状沟纹，底部中心有圆形凹陷的珠孔，其旁有一明显疤痕状种脐。质坚硬，不易破碎，断面可见棕色种皮与白色胚乳相间的大理石样花纹。气微，味涩、微苦。大黄（A错）：【性状鉴别】药材呈类圆柱形、圆锥形、卵圆形或不规则块片状。除尽外皮者表面黄棕色至红棕色，有的可见类白色网状纹理及“星点”（异型维管束）散在，残留的外皮棕褐色，多具绳孔及粗皱纹。质坚实，有的中心稍松软，断面淡红棕色或黄棕色，显颗粒性；根茎髓部宽广，有“星点”环列或散在；根木部发达，具放射状纹理，形成层环明显，无“星点”。气清香，味苦而微涩，嚼之粘牙，有沙粒感。鸡血藤（B错）：【性状鉴别】药材呈椭圆形、长矩圆形或不规则的斜切片。栓皮灰棕色，有的可见灰白色斑块，栓皮脱落处显红棕色。质坚硬。切面木部红棕色或棕色，导管孔多数；韧皮部有树脂状分泌物呈红棕色至黑棕色，与木部相间排列呈数个同心性椭圆形环或偏心性半圆形环；髓部偏向一侧。气微，味涩。大血藤（D错）：【性状鉴别】药材呈圆柱形，略弯曲。表面灰棕色，粗糙，外皮常呈鳞片状剥落，剥落处显暗红棕色，有的可见膨大的节及略凹陷的枝痕或叶痕。质硬，断面皮部红棕色，有数处向内嵌入木部，木部黄白色，有多数细孔状导管，射线呈放射状排列。气微，味微涩。